异位妊娠最常见的发生部位为
A. 输卵管峡部
B. 输卵管壶腹部
C. 输卵管间质部
D. 输卵管系膜
E. 输卵管伞端

正确答案：B。输卵管壶腹部

解析：异位妊娠依部位不同分为：输卵管妊娠、卵巢妊娠、腹腔妊娠、阔韧带妊娠、宫颈妊娠。输卵管妊娠占异位妊娠的绝大多数（95%左右），其中以壶腹部（B对）妊娠最多见（约占78%），其次为峡部（A错）、伞部（E错），间质部（C错）妊娠较少见。输卵管系膜（D错）是输卵管以下、卵巢附着处以上的阔韧带，阔韧带妊娠少见。